患者，男性，50岁。口腔腭部破溃疼痛1个月余。有反复发作史。口腔检查：软腭部1个大而深的溃疡，直径1.5cm，似弹坑状，周边红肿隆起但整齐，底部微凹，表面有假膜，可见腭垂有缺损。初步诊断为
A. 癌性溃疡
B. 结核性溃疡
C. 创伤性溃疡
D. 复发性重型阿弗他溃疡
E. 坏死性涎腺化生

正确答案：D。复发性重型阿弗他溃疡

解析：本题考查复发性阿氟他溃疡的临床表现。该患者软腭部有弹坑状的大而深的溃疡，表面被覆假膜，且腭垂有组织缺损，患者的病史特点和临床特征符合本病，可以判定该患者所患疾病为复发性重型阿弗他溃疡（D对）。癌性溃疡（A错）深浅不一，边缘不齐，底部呈菜花状，无周期性复发、无自限性，全身状况弱或恶病质，与该患者临床表现不符。结核性溃疡（B错）形状不规则，周围轻度浸润，呈鼠噬状，底部肉芽组织，无周期性复发、无自限性，有肺结核体征。创伤性溃疡（C错）的溃疡深浅不一，形状不规则，无周期性复发、无自限性。坏死性涎腺化生（E错）的溃疡底部为肉芽组织，无周期性复发的特点。